男性，25岁。主诉心前区疼痛2小时，向左肩放射，吸气时疼痛加重，坐位时减轻，伴有畏寒、发热就诊，体检：血压105/75mmHg，体温38度，心率110次/分，规则，心脏无杂音，两肺未见异常，有血吸虫病史。心电图示除aVR与V₁外各导联ST段抬高。本例正确治疗是
A. 手术取出栓子
B. 冠脉造影伴紧急PTCA
C. 心包穿刺
D. 大剂量抗生素静脉滴注
E. 应用升压药以及强心利尿剂

正确答案：C。心包穿刺

解析：患者青年男性，心前区疼痛2小时，向左肩放射，吸气时疼痛加重，坐位时减轻（急性心包炎的典型胸痛特点），伴有畏寒发热（提示可能有病毒感染）；心电图示除aVR与V₁外各导联ST段抬高（急性心包炎常见的心电图表现），根据患者急性起病、典型胸痛和心电图表现，其最可能的诊断是急性心包炎。急性心包炎常可导致大量心包积液，因此本例正确治疗是心包穿刺（C对）。手术取出栓子（A错）多用于深静脉血栓或肺栓塞的治疗。冠脉造影伴紧急PTCA（经皮球囊冠状动脉成形术）（P226）（B错）主要用于急性心肌梗死的血管重建治疗。大剂量抗生素静脉滴注（D错）多用于严重感染，如菌血症，感染性休克等。应用升压药以及强心利尿剂（E错）主要用于急性心力衰竭患者的治疗。